易引起伤害的致病因子是
A. 物质
B. 能量
C. 宿主
D. 环境
E. 车祸

正确答案：B。能量